8岁男孩，浮肿，尿色红2天入院，查体：颜面眼睑浮肿，心肺听诊无异常，尿常规有红细胞（+++），蛋白（+），患儿半月前患过扁桃体炎。若患儿在病程中出现呼吸增快，心率增快，奔马律，双肺布满中、小水泡音，肝大，BP120/80mmHg。应首先考虑发生
A. 急性肺炎
B. 严重循环充血
C. 急性肾功能不全
D. 高血压脑病
E. 低钠血症

正确答案：B。严重循环充血

解析：8岁男孩，浮肿，尿色红2天入院，查体：颜面眼睑浮肿，心肺听诊无异常，尿常规有红细胞（+++），蛋白（+），患儿半月前患过扁桃体炎等表现提示该患儿可能患有急性肾小球肾炎，而患儿在病程中出现呼吸增快，心率增快，奔马律，双肺布满中、小水泡音，肝大，BP120/80mmHg等表现符合急性肾炎严重表现之严重循环充血（B对），如呼吸困难、端坐呼吸、颈静脉怒张、频咳、咳粉红色泡沫痰、两肺满布湿啰音、心脏扩大，甚至出现奔马率等。而急性肺炎（A错）是指病程＜1个月，由不同病原体或其他因素（如吸入羊水、油类或过敏反应等）所引起的肺部炎症。主要临床表现为发热、咳嗽、气促、呼吸困难和肺部固定性中、细湿啰音，故该患儿不考虑此病。急性肾功能不全（C错）和高血压脑病（D错）均为急性肾炎的严重表现，前者常发生在疾病早期，血压高达150～160mmHg/100～110mmHg以上，年长儿会主诉剧烈头痛、呕吐、复视或一过性失明；后者常发生于疾病初期，出现尿少、尿闭等症状，引起暂时性氮质血症和代谢性酸中毒，故该患儿不考虑此病。低钠血症（E错）常出现在肾病综合征中，由于患儿不恰当长期禁用食盐或长期食用不含钠的食盐代用品、过多使用利尿剂以及感染、呕吐、腹泻等因素引起。